不属于传染性非典型肺炎糖皮质激素的使用指征是
A. 严重中毒症状
B. 经对症治疗5天以上最高体温仍超过39℃
C. X线胸片显示多发或大片阴影
D. 达到急性肺损伤或ARDS诊断标准
E. 全身关节肌肉酸痛

正确答案：E。全身关节肌肉酸痛

解析：非典型肺炎出现全身关节肌肉酸痛（E错，为本题正确答案）者，为炎症反应，采用解热镇痛药便可治疗；糖皮质激素应用目的在于抑制异常的免疫病理反应，减轻严重的全身炎症反应状态，防止或减轻后期的肺纤维化。具备以下指征之一时可考虑应用糖皮质激素：①有严重的中毒症状（A对），持续高热不退，经对症治疗5天以上最高体温仍超过39℃（B对）②X线胸片显示多发或大片阴影（C对），进展迅速，48小时之内病灶面积增大超过50%且在正位胸片上占双肺总面积的1∕4以上③达到急性肺损伤或ARDS的诊断标准（D对）。